下列说法符合我国人类辅助生殖技术伦理原则的是
A. 对已婚女性可以实施商业性代孕技术
B. 对离异单身女性可以实施商业性代孕技术
C. 对任何女性都不得实施代孕技术
D. 对自愿的单身女性可以实施代孕技术
E. 对已婚女性可以实施亲属间的代孕技术

正确答案：C。对任何女性都不得实施代孕技术

解析：本题考查我国辅助生殖技术应用伦理准则。我国人类辅助生殖技术伦理原则是对任何女性都不得实施代孕技术（C对）。我国辅助生殖技术应用伦理准则：1.有利于患者；2.知情同意；3.保护后代：医务人员不得对近亲间及任何不符合道德的精子和卵子实施人类辅助生殖技术（E错）；4.社会公益；5.保守医密；6.严防商业化（AB错）；7.伦理监督。